女，65岁。劳累时剑突下疼痛，2小时前因情绪激动再次发作，疼而较前加剧，含服硝酸甘油不缓解，伴恶心。糖尿病病史8年。心电图：Ⅱ、Ⅲ、aVF导联ST段弓背向上抬高伴T波倒置。患者就诊过程中出现头晕、黑朦，BP70/60mmHg，心率35次/分。给予阿托品治疗后症状无改善，需立即给予的治疗措拖是
A. 营养心肌冶疗
B. 植入临时心脏起搏器
C. 抗凝治疗
D. 植入永久心脏起搏器
E. 硝酸酯类药物治疗

正确答案：B。植入临时心脏起搏器

解析：老年女性患者，多年糖尿病病史（冠心病的危险因素），劳累时剑突下疼病（心绞痛），时前因情绪激动再次发作，疼而较前加剧（症状加重），含服硝酸甘油不缓解，伴恶心。Ⅱ、Ⅲ、aVF导联ST段弓背向上抬高伴T波倒置（STEMI特征性表现）。因此诊断为STEMI。患者就诊过程中出现头晕、黑朦，BP70/60mmHg，心率35次/分。缓慢性心律失常，给予阿托品治疗后症状无改善。房室传导阻滞，伴有血流动力学障碍，需立即给予的治疗措拖是植入临时心脏起搏器（B对）。